治疗噎膈气虚阳微证，偏于肾虚者，应首选
A. 启膈散
B. 五汁安中饮
C. 通幽汤
D. 右归丸
E. 左归丸

正确答案：D。右归丸

解析：噎嗝之气虚阳微证的病机是脾肾阳虚，中阳衰微，以致温煦失职，气不化津。治以温肾补脾，偏于肾虚者，用温肾的右归丸（D对）。启膈散，其功用为理气化痰解郁，润燥和胃降逆，可用于噎嗝之痰气交阻证（A错）。五汁安中饮，其功用为养血润燥，消瘀化痰，可用于治疗火盛血枯，痰瘀互阻之噎膈(B错)。通幽汤，其功用为滋阴养血，破血行瘀，可用于噎嗝之瘀血内结证（C错）。左归丸，其功用为滋阴补肾，填精益髓，适用于真阴不足证（E错）。